桩冠修复的患牙应选用下列哪项根充材料
A. 氢氧化钙糊剂
B. 牙胶尖+氢氧化钙糊剂
C. 银尖+糊剂
D. 塑化液
E. 氧化锌糊剂

正确答案：B。牙胶尖+氢氧化钙糊剂

解析：为了保证根尖封闭的效果，对于桩冠修复的患牙一般需要糊剂与牙胶合并使用。掌握“根管充填”知识点。